肠溶性薄膜包衣材料有
A. HPMC
B. HPMCP
C. Eudragit L
D. CAP
E. PVP

正确答案：B、C、D。HPMCP；Eudragit L；CAP

解析：本题考查片剂的包衣。羟丙甲纤维素酞酸酯（HPMCP）（B对）、甲基丙烯酸共聚物（Eudragit L）（C对）、醋酸纤维素酞酸酯（CAP）在胃中不溶，可在肠溶液中溶解，为肠溶型材料；HPMC（A错）、聚乙烯吡咯烷酮（PVP）（E错）均为胃溶型薄膜包衣材料。